患者，男性，35岁。上唇部肿胀疼痛3天，伴发热症状，肿胀的唇部皮肤与黏膜上出现多数的黄白色脓头，破溃后溢出脓血样分泌物，病变区呈紫红色，体温38.5℃。根据上述症状，该患者最可能的诊断是
A. 上唇脓肿
B. 上唇疖
C. 上唇痈
D. 慢性唇炎
E. 过敏性唇炎

正确答案：C。上唇痈

解析：本题考查面部疖痈。该患者最可能的诊断是上唇痈（C对）。痈好发于唇部（唇痈），上唇多于下唇，男性多于女性。初期肿胀的唇部皮肤与黏膜上出现多数的黄白色脓头，破溃后溢出脓血样分泌物，脓头周围组织亦有坏死，坏死组织溶解排出后，可形成多数蜂窝状腔洞。继之，腔洞之间皮肤、黏膜或皮下组织亦可发生坏死，致使整个痈的病变区上层组织呈紫红色，痈周围和深部的组织则呈浸润性水肿。